对重症煤气中毒昏迷的患者，最有效的抢救措施是
A. 鼻导管吸氧
B. 20%甘露醇快速静脉推入
C. 冬眠疗法
D. 血液透析
E. 高压氧舱治疗

正确答案：E。高压氧舱治疗

解析：对于煤气中毒昏迷患者应：（1）纠正缺氧，迅速纠正缺氧状态。高压氧舱治疗能增加血液中溶解氧，提高动脉血氧分压，使毛细血管内的氧容易向细胞内弥散，可迅速纠正组织缺氧（E对）。吸入氧气可加速COHb解离。增加CO的排出。吸入新鲜空气时，CO由COHb释放出半量约需4小时；吸入纯氧时可缩短至30～40分钟，吸入3个大气压的纯氧可缩短至20分钟（A错）。防治脑水肿，严重中毒后，脑水肿可在24～48h发展到高峰。脱水疗法很重要。目前最常用的是20%甘露醇，静脉快速滴注（B错）。治疗感染和控制高热，应作咽拭子、血、尿培养，选择广谱抗生素。高热能影响脑功能，可采用物理降温方法，如头部用冰帽，体表用冰袋，使体温保持在32℃左右。如降温过程中出现寒战或体温下降困难时，可用冬眠药物（C错）。呼吸停止时，应及早进行人工呼吸，或用呼吸机维持呼吸。危重病人可考虑血浆置换（D错）。